公孙穴位于
A. 第一跖骨小头后缘，赤白肉际处
B. 第一跖骨小头前缘，赤白肉际处
C. 第一跖骨趾关节部，赤白肉际处
D. 第一跖骨基底部前下缘，赤白肉际处
E. 第一跖骨基底部后下缘，赤白肉际处

正确答案：D。第一跖骨基底部前下缘，赤白肉际处

解析：该题考查腧穴的定位，注意与相近穴位区别，避免混淆。例：太白穴位于第1跖骨小头后缘，赤白肉际凹陷处（D对）。